患者，女，62岁。既往有糖尿病和冠心病。平时有劳累时胸痛发作，近日安静时亦有胸痛发作，胸痛较剧，痛有定处，入夜加重。舌紫暗，有瘀斑，脉涩。心电图Ⅱ、Ⅲ、aVF导联T波倒置，心肌酶谱正常，应首先考虑的方剂是
A. 血府逐瘀汤
B. 瓜蒌薤白桂枝汤合涤痰汤
C. 枳实薤白桂枝汤合当归四逆汤
D. 生脉散合炙甘草汤
E. 参附汤合右归丸

正确答案：A。血府逐瘀汤

解析：患者因气郁日久，瘀血内停，络脉不通故见胸痛较剧；血脉凝滞故见痛有定处；血属阴，夜亦属阴，故见入夜加重；瘀血阻滞，心失所养，故心悸不宁；舌紫暗，有瘀斑，脉涩，均为瘀血日久之象，故可诊断为心血瘀阻证，其治法为活血化瘀，通脉止痛，方药选用血府逐瘀汤加减（A对）。瓜蒌薤白桂枝汤合涤痰汤（B错）可以通阳泄浊，豁痰开痹，用于治疗痰浊内阻证。枳实薤白桂枝汤合当归四逆汤（C错）可以辛温通阳，开痹散寒，用于治疗阴寒凝滞证。生脉散合炙甘草汤（D错）可以益气养阴，活血通络，用于治疗气阴两虚证。参附汤合右归丸（E错）可以益气壮阳，温经止痛，用于治疗心肾阳虚证。